三羧酸循环的酶位于
A. 线粒体外膜
B. 线粒体内膜
C. 线粒体膜间腔
D. 线粒体基质
E. 线粒体内膜F1F0复合体

正确答案：D。线粒体基质